氨基酰tRNA合成酶的特点正确的是
A. 存在于细胞核中
B. 催化反应需GTP
C. 对氨基酸、tRNA都有专一性
D. 直接生成甲酰蛋氨酰tRNA
E. 只对氨基酸有绝对专一性

正确答案：C。对氨基酸、tRNA都有专一性